某女，35岁。自觉咽喉部不适，常感咽部干燥，微痛，干痒，灼热，有异物感，干咳少痰，伴颧红潮热，耳鸣多梦；舌红苔少，脉细数。宜选用的中成药是
A. 清咽利膈丸
B. 六神丸
C. 板蓝根颗粒
D. 知柏地黄丸
E. 金嗓开音丸

正确答案：D。知柏地黄丸

解析：本题考查的是咽喉肿痛虚火上炎证的方剂应用。某女，35岁。自觉咽喉部不适，常感咽部干燥，微痛，干痒，灼热，有异物感，干咳少痰，伴颧红潮热，耳鸣多梦；舌红苔少，脉细数。宜选用的中成药是知柏地黄丸（D对）。咽喉肿痛虚火上炎证【症状】咽部干燥，微痛，干痒，灼热，有异物感，干咳少痰，或痰中带血；或伴颧红潮热，耳鸣多梦。舌红，苔少，脉细数。【方剂应用】基础方剂养阴清肺汤（玄参、甘草、白芍、麦冬、生地、薄荷、贝母、丹皮）或知柏地黄丸（知母、黄柏、熟地、山药、茯苓、泽泻、丹皮、山茱萸）加减。咽喉肿痛火毒上攻证【症状】咽喉疼痛红肿，吞咽困难，咽喉如梗，咽部红肿明显，颌下有臖核、压痛，伴发热，口渴喜饮，疼痛剧烈，小便短赤，大便秘结。舌质红，苔黄，脉数有力。【方剂应用】基础方剂清咽利膈汤（A错）（玄参、升麻、桔梗、甘草、茯苓、黄连、黄芩、牛蒡子、防风、芍药）加减。【中成药应用】合理用药与用药指导阴虚火旺者、老人及素体脾胃虚弱者慎用板蓝根颗粒（C错）和六神丸（B错）。六神丸含蟾酥、雄黄有毒物质，不宜过量、久用。咽喉肿痛风热外袭证【症状】咽部疼痛，逐渐加重，吞咽或咳嗽时疼痛加剧，咽部红肿，颌下有臖核；伴见发热恶风，头痛，咳嗽痰黄。舌质红，苔黄，脉浮数。【中成药应用】合理用药与用药指导孕妇禁用清咽利膈丸，老人、儿童及虚火喉痹、脾胃虚弱者慎用。虚火喉痹、喉喑者慎用金嗓开音丸（E错）。虚火喉痹、乳蛾者慎用复方鱼腥草片。